患者心理问题的基本干预方法不包括
A. 支持疗法
B. 脱敏疗法
C. 认知疗法
D. 行为治疗技术
E. 健康教育和咨询

正确答案：B。脱敏疗法

解析：患者心理问题的基本干预方法包括：支持疗法；认知疗法；行为治疗技术；健康教育和咨询。掌握“特殊患者心理”知识点。